结核分枝杆菌敏感的理化因素
A. 碱
B. 酸
C. 紫外线
D. 干燥
E. 寒冷

正确答案：C。紫外线

解析：结核分枝杆菌的脂类含量高，对某些理化因子的抵抗力较强。在干痰中可存活6~8个月，若黏附于尘埃上，可保持传染性8~10天。在3%HCl、6%H₂SO4或4%NaOH溶液中能耐受30分钟，因而常以酸碱处理严重污染的样本，杀死杂菌和消化黏稠物质，以提高检出率。但是其对湿热、紫外线（C对）、乙醇的抵抗力弱。在液体中加热62~63℃15分钟或煮沸、直射日光下2~3小时、75%乙醇内数分钟即死亡。结核分枝杆菌对干燥（D错）、冷（E错）、酸（B错）、碱（A错）等抵抗力强。